肺胀患者，出现肺部感染，右心衰竭.呼吸衰竭。应首选的治疗措施是
A. 纠正缺氧
B. 纠正呼吸衰竭
C. 治疗原发病
D. 抗感染
E. 纠正心衰

正确答案：D。抗感染

解析：因为肺部感染是引起右心衰竭和呼吸衰竭的诱因，故首选的治疗措施为抗感染（D对），纠正缺氧（A错）、纠正呼吸衰竭（B错）、治疗原发病（C错）、纠正心衰（E错）均为对症治疗，不是首选的治疗措施。